关于实验流行病学描述正确的是
A. 为病因研究提供线索
B. 提出病因假设
C. 证实或确证假设
D. 是分析性研究的基础
E. 描述疾病和健康状态的分布

正确答案：C。证实或确证假设

解析：本题考查实验流行病学的用途。实验流行病学主要是为了证实或确证假设（C对ABDE错）。